具有强烈传染性的病邪是
A. 六淫
B. 过逸
C. 七情
D. 痰饮、瘀血
E. 疠气

正确答案：E。疠气

解析：疠气的致病特点：①发病急骤，病情危笃；②传染性强，易于流行；③一气一病，症状相似（E对）。六淫（A错）的致病特点：外感性；季节性；地域性；相兼性。过逸（B错）的致病特点：①安逸少动，气机不畅；②阳气不振，正气虚弱；③长期用脑过少，加之阳气不振，可致神气衰弱，常见精神萎靡，健忘，反应迟钝。七情（C错）内伤的致病特点：直接损伤内脏；影响脏腑病机；多发为情志病。痰饮、瘀血（D错）、结石等是疾病过程中形成的病理产物。